甲状腺下动脉通常起于
A. 甲状颈干
B. 颈总动脉
C. 颈外动脉
D. 颈内动脉
E. 锁骨下动脉

正确答案：A。甲状颈干

解析：甲状颈干（A对）分为甲状腺下动脉、肩胛上动脉等数支，分布于甲状腺、咽、食管、喉、气管以及肩部肌、脊髓及其被膜等处。